从橄榄后沟出入脑的神经从上向下依次为
A. 舌下神经、迷走神经
B. 舌咽神经、迷走神经、副神经
C. 迷走神经、副神经、舌下神经
D. 展神经、面神经、前庭蜗神经
E. 面神经、前庭蜗神经、舌咽神经、副神经

正确答案：B。舌咽神经、迷走神经、副神经

解析：从橄榄后沟出入脑的神经从上向下依次为舌咽神经、迷走神经、副神经（B对）。